客观事物歪曲的知觉是
A. 幻觉
B. 妄想
C. 错觉
D. 虚构
E. 感知综合障碍

正确答案：C。错觉

解析：客观事物歪曲的知觉是错觉（C对）。幻觉是没有现实刺激作用于感觉器官时出现的知觉体验，是一种虚幻的知觉（A错）。妄想是在病态推理和判断基础上形成的一种病理性的歪曲的信念（B错）。虚构是指在遗忘的基础上，患者以想象的、未曾亲身经历的事件来填补记忆的缺损（D错）。感知综合障碍是指患者对客观事物的整体属性能够正确感知，但对某些个别属性如大小、形状、颜色、距离、空间位置等产生错误的感知（E错）。